3岁男性幼儿，皮肤出现鳞屑样炎症，伴有湿疹，经实验检查，血中二十碳三烯酸与二十碳四烯酸比值增高。该患儿最可能是
A. 必需氨基酸不足
B. 维生素A缺乏
C. 维生素PP缺乏
D. 必需脂肪酸缺乏
E. 维生素C缺乏

正确答案：D。必需脂肪酸缺乏